治疗热毒蕴结，咽喉肿痛应首选
A. 射干
B. 马勃
C. 蚤休
D. 板蓝根
E. 山豆根

正确答案：E。山豆根

解析：山豆根功善清肺火，解热毒，利咽消肿，为治疗火毒蕴结所致乳蛾喉痹、咽喉红肿疼痛的要药（E对）。射干（A错）长于清泻肺火，有清热解毒、祛痰、利咽之效，为治热毒痰火郁结所致咽喉肿痛的要药。马勃（B错）既能宣散肺经风热，又能清泻肺经实火，长于解毒利咽，为治咽喉肿痛的常用药。蚤休（C错）善于清热解毒，消肿止痛，为治痈肿疔毒，毒蛇咬伤的常用药。板蓝根（D错）善于清解实热火毒，以解毒利咽散结见长。